首先考虑为肝癌腹水的是
A. 漏出液
B. 渗出液
C. 血性
D. 脓性
E. 乳糜性

正确答案：C。血性

解析：肝硬化患者的腹水属于漏出液，一般呈淡黄色。当肝硬化进展到肝癌时，病变可以累及血管，可抽出血性（C对）腹水。漏出液（A错）为非炎性积液，主要见于晚期肝硬化、肾病综合征、重度营养不良等。渗出液（B错）为炎性积液，主要见于感染、外伤、化学刺激、风湿性疾病等。脓性（D错）积液由化脓性细菌感染引起，主要见于腹膜腔化脓性炎症等。乳糜性（E错）积液常常是由于淋巴回流受阻所致，主要见于结核等。